《公共场所卫生管理条例》是国务院于
A. 1985年发布的
B. 1987年发布的
C. 1991年发布的
D. 1996年发布的
E. 2001年发布的

正确答案：B。1987年发布的

解析：本题考查《公共场所卫生管理条例》的发布时间。为加强对公共场所的卫生监督，创造良好的公共场所卫生环境，防止疾病的传播，保障人民健康，国务院1987年（B对ACDE错）颁布了《公共场所卫生管理条例》。